患者女性，20岁，乳房肿块，边缘清晰，活动度大，生长缓慢，无压痛，应诊断为
A. 乳腺结核
B. 乳腺炎性肿块
C. 乳腺囊性增生病
D. 乳管内乳头状瘤
E. 乳腺纤维性腺瘤

正确答案：E。乳腺纤维性腺瘤